据《药品医疗器械飞行检查办法》，关于药品飞行检查启动和实施的说法，错误的是
A. 药品监督管理部门接到投诉举报的，可以开展飞行检查
B. 药品监督管理部门派出的检查组，应当由2名以上检查人员组成
C. 检查人员到达检查现场后，应当出示相关证件和执法证明文件
D. 被检查单位应当立即暂停生产经营活动，以配合药品飞行检查

正确答案：D。被检查单位应当立即暂停生产经营活动，以配合药品飞行检查

解析：本题考查飞行检查的实施。被检查单位及有关人员应当及时按照检查组要求，明确检查现场负责人，开放相关场所或者区域，配合对相关设施设备的检查，保持正常生产经营状态，提供真实、有效、完整的文件、记录、票据、凭证、电子数据等相关材料，如实回答检查组的询问（D错，为本题正确答案）。开展飞行检查有下列情形之一的，药品监督管理部门可以开展药品飞行检查：①投诉举报或者其他来源的线索表明可能存在质量安全风险的（A对）；②检验发现存在质量安全风险的；③药品不良反应提示可能存在质量安全风险的；④对申报资料真实性有疑问的；⑤涉嫌严重违反质量管理规范要求的；⑥企业有严重不守信记录的；⑦其他需要开展飞行检查的情形。药品监督管理部门派出的检查组应当由2名以上检查人员组成（B对）。检查组到达检查现场后，检查人员应当出示相关证件和受药品监督管理部门委派开展监督检查的执法证明文件，通报检查要求及被检查单位的权利和义务（C对）。